一名3月龄婴儿，纯母乳喂养，从未添加其他饮食。近日发现有食欲不振、呕吐、心跳快、呼吸急促和呼吸困难，时有强直性痉挛发生。检查发现有轻度水肿、心脏扩大。进一步了解，其母亲有乏力、食欲较差、易心悸、气喘等症状。可能的诊断是
A. 维生素A缺乏
B. 维生素B₁缺乏
C. 维生素B₂缺乏
D. 尼克酸缺乏
E. 维生素C缺乏

正确答案：B。维生素B₁缺乏